临床上对乳牙近髓深龋的治疗最好采用
A. 直接盖髓
B. 间接盖髓
C. 冠髓切除术
D. 干髓术
E. 根管治疗

正确答案：B。间接盖髓

解析：本题考查间接盖髓术的适应证。临床上对乳牙近髓深龋的治疗最好采用间接盖髓（B对）。1.间接盖髓术的适应证：深龋近髓或外伤牙冠折断近髓无明显牙髓炎症症状的患牙；症状轻微的轻度牙髓充血的患牙。2.乳牙直接盖髓术（A错）适用于牙髓活力正常的乳牙，备洞或外伤导致的机械性针尖大小的露髓。乳牙龋源性露髓或去龋未净时的意外露髓，其牙髓都可能已被感染，不宜行直接盖髓术。3.乳牙牙髓切断术（C错）的适应证：（1）牙髓活力正常的乳牙，因备洞或外伤导致的机械性露髓，露髓孔较大，不宜进行直接盖髓术者。（2）无不可逆性牙髓炎症状或体征、无病理性影像学改变的乳牙、龋源性露髓，冠髓切断后，根方牙髓组织活力正常，无化脓、牙髓坏死或出血不止等。4.干髓术（D错）适用于乳磨牙早期牙髓炎。5.乳牙根管治疗术（E错）的适应证：（1）牙髓炎症涉及根髓，不宜行牙髓切断术的乳牙。（2）牙髓坏死而应保留的乳牙。（3）根尖周炎症而具有保留价值的乳牙。